《中国药典》规定，黄连含量测定的指标成分是
A. 胡椒碱
B. 小檗碱
C. 药根碱
D. 金雀花碱
E. 秋水仙碱

正确答案：B。小檗碱

解析：本题考查的是黄连的化学成分。《中国药典》规定，黄连含量测定的指标成分是小檗碱（B对）。《中国药典》以小檗碱为指标成分对黄连进行含量测定。简单吡啶类此类生物碱分子较小，结构简单，很多呈液态。如槟榔中的槟榔碱、槟榔次碱，烟草中的烟碱，胡椒中的胡椒碱（A错）等。黄连的有效成分主要是生物碱，已经分离出来的生物碱有小檗碱、巴马汀、黄连碱、甲基黄连碱、药根碱（C错）和木兰碱等。双稠哌啶类由两个哌啶环共用一个氮原子稠合而成的杂环，具喹诺里西啶的基本母核。主要分布于豆科、石松科和千屈菜科。如苦参中的苦参碱、氧化苦参碱，野决明中的金雀花碱（D错）等。有机胺类生物碱这类生物碱的结构特点是氮原子不在环状结构内，如麻黄中的麻黄碱，秋水仙中的秋水仙碱（E错），益母草中的益母草碱等。